我国现阶段采用的围生期规定为
A. 从胚胎形成至产后1周
B. 从妊娠满20周至产后4周
C. 从妊娠满24周至产后1周
D. 从妊娠满28周至产后1周
E. 从妊娠满28周至产后4周

正确答案：D。从妊娠满28周至产后1周

解析：我国现阶段采用的围生期规定为从妊娠满28周至产后1周（D对）。